外来化学物在胎儿期和新生儿期的主要影响是
A. 生长迟缓和功能不全
B. 畸形
C. 胚胎死亡
D. 着床减少
E. 以上都不是

正确答案：A。生长迟缓和功能不全